咽侧壁处有咽鼓管咽口，它的位置在
A. 上鼻甲后方
B. 中鼻甲后方
C. 下鼻甲后方
D. 腭扁桃体后方
E. 蝶筛隐窝前方

正确答案：C。下鼻甲后方

解析：咽鼓管咽口位于下鼻甲后方(C对)约1cm处。